取药材数粒，加水共研，产生苯甲醛特殊香气的是
A. 决明子
B. 金樱子
C. 苦杏仁
D. 补骨脂
E. 酸枣仁

正确答案：C。苦杏仁

解析：本题考查的是苦杏仁的化学成分。取药材数粒，加水共研，产生苯甲醛特殊香气为苦杏仁（C对）。苦杏仁主要含有苦杏仁苷，《中国药典》以苦杏仁苷为指标成分进行含量测定，规定含量不得少于3.0%。苦杏仁苷是一种氰苷，易被酸和酶所催化水解。水解所得到的苷元α-羟基苯乙腈很不稳定，易分解生成苯甲醛和氢氰酸。其中苯甲醛具有特殊的香味。通常将此作为鉴别苦杏仁苷的方法。其具体操作为：取本品数粒，加水共研，发生苯甲醛的特殊香气。决明子（A错）中含有蒽醌类、萘并吡咯酮类、脂肪酸类等化学成分。其中，蒽醌类化合物为其主要成分，含量约1%，主要为大黄酚、大黄素甲醚、决明素、橙黄决明素、黄决明素、美决明素、葡萄糖美决明素、葡萄糖橙黄决明素。《中国药典》以大黄酚、橙黄决明素为指标成分进行含量测定，含量分别不得少于0.20%和0.80%。补骨脂（C错）含有多种香豆素类成分，包括补骨脂内酯（补骨脂素）、异补骨脂内酯（异补骨脂素）和补骨脂次素等。《中国药典》采用高效液相色谱法测定药材中补骨脂素和异补骨脂素含量，两者总含量不得少于0.70%。酸枣仁（E错）含白桦醇和白桦酸，属于五环三萜。金樱子（B错）的化学成分，2022年考试指南未明确说明。